“阳生阴长，阳杀阴藏”所体现的阴阳关系是
A. 阴阳制约
B. 阴阳互根互用
C. 阴阳互藏
D. 阴阳转化
E. 阴阳自和与平衡

正确答案：B。阴阳互根互用

解析：“阳生阴长”指阴和阳能够相互促进生长；“阳杀阴藏”指阳气肃杀收束，则阴气封蛰潜藏，此句说明阴阳互根的关系（B对）。阴阳对立的形式，通过阴阳之间的相互斗争、相互制约而发挥作用 阴可制约阳，阳能制约阴（A错）。“阴阳互藏”，指相互对立的阴阳双方中的任何一方都包含着另一方，即阴中有阳，阳中有阴（C错）。阴阳自和，是相对的、动态的平衡，阴阳双方在交互作用中处于大体均势的状态，即阴阳协调和相对稳定状态。阴阳双方以对立制约与互根互用为基础，在一定限度内消长和在一定条件下转化的运动变化，维持阴阳平衡状态（E错）。